DNA上某段碱基顺序为ATCGGC其互补链的碱基顺序是
A. ATCGGC
B. TAGCCG
C. GCCGAT
D. UAGCCG
E. GCCGAU

正确答案：C。GCCGAT